某女，56岁。近日出现气短心悸、失眠多梦、头昏头晕、肢倦乏力、食欲不振、崩漏便血等症。遂就医，医师诊断为心脾两虚，处以归脾丸。处方组成：党参80g、炒白术160g、炙黄芪80g、炙甘草40g、茯苓160g、制远志160g、炒酸枣仁80g、龙眼肉160g、当归160g、木香40g、大枣（去核）40g。以上十一味，党参、当归、炙甘草、木香粉碎成细粉，其余炒白术等七味，加水煎煮两次，合并煎液，滤过，浓缩得稠膏，与上述粉末混匀，制成浓缩水丸。关于该制剂水分、溶散时限正确的是
A. 水分不得过5.0%，在15分钟内全部溶散
B. 水分不得过9.0%，在2小时内全部溶散
C. 水分不得过12.0%，在1小时内全部溶散
D. 水分不得过15.0%，在1.5小时内全部溶散
E. 水分不得过8.0%，在30分钟内全部溶散

正确答案：B。水分不得过9.0%，在2小时内全部溶散

解析：本题考查丸剂的质量要求。结合题目剂型为浓缩水丸，下列关于该制剂的水分和溶散时限正确的是水分不得过9.0%，在2小时内全部溶散（B对）。丸剂的质量要求：（1）除另有规定外，蜜丸和浓缩蜜丸中所含水分不得过15.0%；水蜜丸和浓缩水蜜丸不得过12.0%；水丸、糊丸、浓缩水丸不得过9.0%。蜡丸不检查水分。（2）溶散时限，除另有规定外，小蜜丸、水蜜丸和水丸应在1小时内全部溶散；浓缩丸和糊丸应在2小时内全部溶散；滴丸应在30分钟内全部溶散，包衣滴丸应在1小时内全部溶散。蜡丸照崩解时限检查法片剂项下的肠溶衣片检查法检查，在盐酸溶液中（9→1000）检查2小时，不得有裂缝、崩解或软化现象，再在磷酸盐缓冲液（pH6.8）中检查，1小时内应全部崩解。除另有规定外，大蜜丸及研碎、嚼碎后或用开水、黄酒等分散后服用的丸剂不检查溶散时限。